羊水栓塞的确诊依据是
A. 突发呼吸困难
B. 查到胎儿有核红细胞
C. 休克及昏迷
D. 出血不止
E. 腔静脉中查到胎脂胎粪

正确答案：E。腔静脉中查到胎脂胎粪

解析：八版妇产科学认为，镜检见到羊水有形成分支持诊断（E对），但是九版妇产科学认为，母血涂片或器官病理检查找到羊水有形成分不是诊断羊水栓塞的必需依据，羊水栓塞的诊断需要有临床表现支持，所以本题无正确答案，原答案选E。突发呼吸困难（A错）、休克及昏迷（C错）、出血不止（D错）不是羊水栓塞的特异性表现，无法确诊。查到胎儿有核红细胞（B错）对羊水栓塞的确诊无意义。